侧腭杆到龈缘的距离应大于
A. 1mm
B. 2mm
C. 3mm
D. 4mm
E. 6mm

正确答案：D。4mm

解析：本题考查侧腭杆。侧腭杆到龈缘的距离应大于4mm（D对）。侧腭杆：位于腭隆突的两侧，离开龈缘4～6mm，与牙弓并行，厚1～1.5mm，宽3～3.5mm。设在一侧或两侧（双杆）均可，用于连接前、后腭杆。注意当联合使用前、后、侧腭杆作为大连接体时，称为前-后杆联合连接体，前腭杆后缘和后腭杆前缘间的距离应不少于15mm。